调查研究的逻辑步骤是
A. 选题和假设，制定研究方案，收集资料，解释结果，整理分析
B. 选题和假设，收集资料，制定研究方案，整理分析，解释结果
C. 收集资料，选题和假设，制定研究方案，整理分析，解释结果
D. 选题和假设，制定研究方案，收集资料，整理分析，解释结果
E. 选题，寻找调查对象，设计调查表格，整理分析，解释结果

正确答案：D。选题和假设，制定研究方案，收集资料，整理分析，解释结果